芒硝与大黄均具有的功效是
A. 活血祛瘀
B. 利水消肿
C. 清热泻火
D. 清热凉血
E. 祛痰利咽

正确答案：C。清热泻火

解析：芒硝性味咸苦寒，归胃、大肠经，功效为泻下通便，润燥软坚，清火消肿。大黄性味苦寒，归脾、胃、大肠、肝、心包经，功效为泻下攻积，清热泻火，凉血解毒，止血，逐瘀通经，利湿退黄。两药均具有的功效为清热泻火（C对ABDE错）。